左侧甲状腺乳头状癌，伴同侧Ⅵ区淋巴结转移，适宜的手术方式为
A. 甲状腺全切除+左侧改良根治性颈淋巴结清扫术
B. 甲状腺左叶切除+左侧改良根治性颈淋巴结清扫术
C. 甲状腺次全切除术+左侧改良根治性颈淋巴结清扫术
D. 甲状腺左叶切除+左侧Ⅵ区淋巴结清扫术
E. 甲状腺左叶部分切除+左侧Ⅵ区淋巴结清扫术

正确答案：C。甲状腺次全切除术+左侧改良根治性颈淋巴结清扫术

解析：患者左侧甲状腺乳头状癌，伴同侧Ⅵ区淋巴结转移，没有器官受累，一般选择改良根治性颈淋巴结清扫术（C对D错）。甲状腺肿瘤的常用术式包括：①腺叶次全切：适用于诊断为良性疾病，但术后病理诊断为孤立性乳头状癌者；②腺叶+峡部切除：适用于肿瘤直径不大于1.5cm，且局限于一叶者；③甲状腺次全切：适用于肿瘤直径大于1.5cm，一侧乳头状癌伴有颈部淋巴结转移者；④甲状腺全切：适用于高度侵袭性乳头状癌、滤泡状癌，明显多灶性，双侧颈淋巴结肿大，肿瘤侵犯颈部组织或有远处转移者；⑤甲状腺全切+患侧颈淋巴结清扫，可用于治疗已有远处转移者。该患者左侧甲状腺乳头状癌，伴同侧VI淋巴结转移，符合甲状腺次全切的手术的指征，故最终选择甲状腺次全切除术+左侧改良根治性颈淋巴结清扫术（AB错）。